病毒的水平传播是指病毒
A. 在细胞与细胞间的传播
B. 从侵入门户向血液中的传播
C. 在人群个体间的传播
D. 通过血液向其他组织传播
E. 沿神经传播

正确答案：C。在人群个体间的传播

解析：病原体离开传染源到达另一个易感者的途径称为传播途径，同一种传染病可有多种传播途径，如：水平传播，即在人群个体间的传播（C对）；垂直传播。水平传播有：1、呼吸道传播2、消化道传播3、接触传播4、虫媒传播5、血液体液传播。垂直传播有母婴传播。在细胞与细胞间的传播（A错）、从侵入门户向血液中的传播（B错）、通过血液向其他组织传播（D错）、沿神经传播（E错）均不是病原体传播途径。